女，33岁。阴道接触性出血。初步诊断为“宫颈癌”。宫颈刮片多次检查为阳性，而宫颈活检为阴性。为确诊需做的进一步检查为
A. 不做任何处理，一月后再次活检
B. 碘试验
C. 宫颈锥切术
D. CT
E. MRI

正确答案：C。宫颈锥切术

解析：患者初步诊断为“宫颈癌”，宫颈刮片多次检查为阳性，而宫颈活检为阴性。为确诊需做的进一步检查为子宫颈锥切术（C对），其适用于子宫颈细胞学检查多次阳性而子宫颈活检阴性者，或子宫颈活检为CINⅡ或CINⅢ需确诊者，或可疑微小浸润癌需了解病灶的浸润深度和宽度等。若不做任何处理、一月后再次活检（A错），病情可能发生恶化，应及时进行检查，确诊病情，制订诊疗方案 。碘试验（B错）、CT（D错）、MRI（E错）对宫颈癌有一定诊断价值，但不是确诊的可靠方法。